多巴胺对心血管系统和肾脏的作用是
A. 大剂量使外周血管扩张、肾血管收缩
B. 大剂量使外周血管收缩、肾血管扩张
C. 小剂量使外周和肾血管收缩
D. 小剂量使外周和肾血管扩张
E. 不影响肾血管和肾血流

正确答案：D。小剂量使外周和肾血管扩张